鱼肝油乳处方如下：【处方】鱼肝油500ml；阿拉伯胶细粉12.5g；西黄蓍胶细粉7g；糖精钠0.1g；挥发杏仁油1ml；羟苯乙酯0.5g；纯化水加至1000ml。处方中，阿拉伯胶用作
A. 防腐剂
B. 矫味剂
C. 溶剂
D. 乳化剂
E. 稳定剂

正确答案：D。乳化剂

解析：本题考查鱼肝油乳处方分析。处方中，阿拉伯胶用作乳化剂（D对）。乳化剂是乳剂的重要组成部分，对于乳剂的形成、稳定性以及药效等方面起重要作用。常用的乳化剂的种类有：（1）表面活性剂；（2）天然高分子乳化剂：如阿拉伯胶、西黄蓍胶、明胶、杏树胶等；（3）固体微粒乳化剂：O/W型乳化剂有氢氧化镁、氢氧化铝、二氧化硅、皂土等；W/O型乳化剂有氢氧化钙、氢氧化锌等。（4）助乳化剂：①增加水相黏度的辅助乳化剂：甲基纤维素、羧甲纤维素钠、羟丙纤维素、海藻酸钠、琼脂西黄蓍胶、阿拉伯胶、黄原胶、果胶、皂土等。②增加油相黏度的辅助乳化剂：鲸蜡醇、蜂蜡、单硬脂酸甘油酯、硬脂酸、硬脂醇等。防腐剂（A错）是指具有抑菌作用，能抑制微生物生长繁殖的物质。常用的防腐剂主要有苯甲酸与苯甲酸钠、对羟基苯甲酸酯类、山梨酸和山梨酸钾、苯扎溴铵等。矫味剂（B错）是指药品中用以改善或屏蔽药物不良气味的，使患者难以觉察药物的强烈苦味的物质。矫味剂分为甜味剂、芳香剂、胶浆剂、泡腾剂等类型。常用的溶剂（C错）有水、甘油、二甲亚砜、乙醇、丙二醇等。稳定剂（E错）是在混悬剂中起润湿、助悬、絮凝或反絮凝作用的附加剂。鱼肝油乳处方中鱼肝油为药物、油相，阿拉伯胶为乳化剂，西黄蓍胶为稳定剂，糖精钠、杏仁油为矫味剂，羟苯乙酯为防腐剂。本药与醋酸曲安奈德配成复方乳膏剂，具有消炎及快速缓解真菌感染症状的双重作用。